常压氧疗对下列何种病变引起的缺氧效果最佳？
A. 高原肺水肿
B. 失血性休克
C. 先天性心脏病所致右－左分流
D. 亚硝酸盐中毒
E. 氮化物中毒

正确答案：A。高原肺水肿

解析：常压氧疗对由先天性心脏病所致右－左分流（C错）的缺氧作用较小。失血性休克（B错）和亚硝酸盐中毒（D错）的患者动脉血氧分压和氧饱和度均正常，此时氧疗的作用主要是通过提高动脉血氧分压、增加血液中物理溶解的氧量，氧向组织、细胞的弥散速度也会加快，改善组织供氧。氮化物中毒（E错）的患者供氧是正常的，此时的主要问题是细胞对氧的利用障碍，氧疗的效果不及其他类型的缺氧。而对于高原肺水肿（A对）的患者来说，大多数经吸氧、休息后，症状缓解，甚至痊愈。